无排卵性功能失调性子宫出血时，应为
A. 月经第5～6日刮宫见子宫分泌反应内膜
B. 经前2日刮宫见子宫内膜分泌反应不良
C. 经前3日刮宫见子宫内膜增生期改变
D. 经前2日刮宫见子宫内膜分泌期改变
E. 刮宫为蜕膜

正确答案：C。经前3日刮宫见子宫内膜增生期改变

解析：正常月经周期中，第1～4日为月经期，月经周期第5～14日为增殖期，即子宫内膜呈增生性内膜，月经周期第15～28日为分泌期，即子宫内膜呈分泌期内膜。但是无排卵性功血患者的子宫内膜受雌激素持续作用而无孕激素拮抗（雌激素促进子宫内膜增生及修复，孕激素则限制子宫内膜增生，并使增生的子宫内膜转化为分泌期），子宫内膜不能由增生期转为分泌期，故经前3日刮宫见子宫内膜增生期改变（C对ABD错）。受精卵着床后，在孕激素、雌激素作用下子宫内膜腺体增大，腺上皮细胞内糖原增加，结缔组织细胞肥大，血管充血，此时的内膜称为蜕膜（P37），无排卵性功能失调性子宫出血时刮宫不会见到蜕膜（E错）。